休克淤血期在补足血容量后应使用
A. 缩血管药
B. 扩血管药
C. 补充血容量
D. 盐皮质激素
E. 心得安

正确答案：B。扩血管药

解析：扩血管药（B对）应根据实际情况使用,在休克淤血期应补足血容量后使用，目的是提高微循环灌流量。在微循环缺血期要强调尽早和尽快补充血容量（C错），以降低交感－肾上腺髓质系统兴奋性，减少儿茶酚胺释放量，缓解微循环前阻力血管收缩程度，提高微循环灌流量，防止休克加重。对过敏性休克应使用缩血管药物（A错）以升高血压，保证心脑重要器官的血液灌流。盐皮质激素（D错）的主要生理作用是促进肾小管重吸收钠而保留水，并排泄钾。心得安（普萘洛尔）（E错）用于治疗多种原因所致的心律失常，也可用于心绞痛、高血压、嗜铬细胞瘤（手术前准备）等。